分析性流行病学常用方法
A. 病例对照研究
B. 横断面研究
C. 纵向研究
D. 常规资料分析
E. 现况调查

正确答案：A。病例对照研究

解析：本题考查流行病学常用方法。分析性流行病学常用方法为病例对照研究（A对）。分析性流行病学就是对所提出的病因假设或影响因素在选择的人群中探索疾病发生的条件和规律，验证病因假设。它主要包括病例对照研究和群组研究。横断面研究（B错）即现况调查（E错），纵向研究（C错）和常规资料分析（D错）属于描述性流行病学。